牡蛎味咸，性微寒，功效为
A. 平肝潜阳
B. 制酸止痛
C. 收敛固涩
D. 镇惊安神
E. 软坚散结

正确答案：A、B、C、D、E。平肝潜阳；制酸止痛；收敛固涩；镇惊安神；软坚散结

解析：本题考查的是牡蛎的功效。牡蛎味咸，性微寒，功效为平肝潜阳（A对）、制酸止痛（B对）、收敛固涩（C对）、镇惊安神（D对）与软坚散结（E对）。牡蛎：【功效】平肝潜阳，镇惊安神，软坚散结，收敛固涩，制酸止痛。